对白色念珠菌有抗菌效果的是
A. 利巴韦林
B. 青霉素
C. 氟康唑
D. 甲硝唑
E. 磺胺类

正确答案：C。氟康唑

解析：白色念珠菌属于真菌，而氟康唑属于抗真菌药物。掌握“氟康唑、利巴韦林及阿昔洛韦”知识点。